水溶液口服可导泻，而注射剂可降压和对抗惊厥的药品是
A. 醋酸氯己定
B. 氨茶碱
C. 硫酸镁
D. 呋塞米
E. 尿素

正确答案：C。硫酸镁

解析：本题考查药物剂型与给药途径的选择。硫酸镁（C对）静脉注射可降压和对抗惊厥；肌内注射可用于治疗子痫；口服可用于导泻；外敷则可消除水肿。醋酸氯己定（A错）溶液用于皮肤及黏膜的消毒，用于创面感染、阴道感染和子宫颈糜烂的冲洗；还能用于含漱，用于牙龈炎、口腔黏膜炎、咽炎等口腔感染情况。氨茶碱（B错）适用于支气管哮喘、喘息型支气管炎、阻塞性肺气肿等缓解喘息症状；也可用于心力衰竭的哮喘(心源性哮喘）。呋塞米（D错）口服用于水肿性疾病、高血压、高钙血症；静脉注射用于水肿性疾病、高血压危象、高钙血症。尿素（E错）的给药途径与用途最新版考试指南未明确说明，但其主要用于治疗脑水肿、青光眼等；皮肤科还可以用含有尿素的某些药剂来提高皮肤的湿度。